患者，男，50岁。既往乙肝病史6年，未间断治疗。上腹饱胀、恶心、呕吐1个月，有时鼻衄。查体：肝病面容，精神萎靡，黄疸，肝未及，叩诊肝浊音区缩小，脾轻度增大，移动性浊音阳性，下肢轻度水肿。应首先考虑的诊断是
A. 慢性肝炎
B. 肝硬化
C. 原发性肝癌
D. 继发性肝癌
E. 重症肝炎

正确答案：B。肝硬化

解析：患者乙肝病史6年。上腹饱胀、恶心、呕吐1个月，有时鼻衄（肝脏合成凝血因子减少），查体：肝病面容，精神萎靡（提示营养不良），黄疸，肝未及，叩诊肝浊音区缩小，脾轻度增大，移动性浊音阳性（提示腹水），下肢轻度水肿，患者应首先考虑的诊断是肝硬化（B对）。慢性肝炎（A错）主要表现为乏力、食欲不振、肝区轻微疼痛、偶见黄疸。原发性肝癌（P430）（C错）患者早期缺乏典型症状，中晚期主要表现为肝大、黄疸、进行性消瘦、发热、食欲不振、营养不良和恶病质等。继发性肝癌（D错）又称转移性肝癌，由其他部位的肿瘤转移而来，常有其他部位肿瘤疾病史。重症肝炎（E错）主要表现为极度乏力、明显厌食、呕吐、腹胀等严重消化道症状。